男性，20岁。活动后心悸气急2月。检查发现肝大，质地中等，表面平滑，有压痛，腹部移动性浊音阳性，下肢压陷性水肿。最可能的诊断是
A. 肝硬化腹水
B. 肝癌伴腹水
C. 肝结核伴结核性腹膜炎
D. 肾病综合征伴腹水
E. 右心衰竭、肝淤血伴腹水

正确答案：E。右心衰竭、肝淤血伴腹水

解析：患者活动后心悸气急，体循环淤血征（肝大、腹水、下肢水肿），可诊断为右心衰竭。掌握“心力衰竭”知识点。